关于学校健康促进的特征的表述，哪项是错误的
A. 承认学校的社会文化精神对于维持积极的学习及支持心理健康等方面的重要性
B. 把区域和地方的卫生服务与学校联系起来，满足学校儿童的特殊健康问题的需求
C. 通过鼓励参与其儿童健康知识和技巧的发展而使家庭参与进来
D. 增加妇女在社区内享有教育和保护健康方面的公平性
E. 以上都不是

正确答案：E。以上都不是